以慢性腰痛和下肢大关节不对称关节炎为特征临床表现的疾病是
A. 腰椎间盘突出症
B. 类风湿关节炎
C. 强直性脊柱炎
D. 痛风关节炎
E. 腰肌劳损

正确答案：C。强直性脊柱炎

解析：强直性脊柱炎多数起病缓慢而隐匿。早期首发症状常为下腰背痛伴晨僵。部分患者首发症状可以是下肢大关节如髋、膝或踝关节痛，常为非对称性（C对）、反复发作与缓解，较少伴发骨关节破坏。腰椎间盘突出症（A错）（九版外科学P732）以腰痛、坐骨神经痛和马尾综合征为主要症状，很少累及关节；类风湿关节炎（B错）（P808）关节痛多呈对称性、持续性；痛风关节炎（D错）（P861）以单侧第1跖趾关节最常见，其余为趾、踝、膝、腕、指、肘关节；腰肌劳损（E错）以无明显诱因的慢性疼痛为主要症状，腰痛为酸胀痛，休息后可缓解，很少累及关节。